流行病学病因研究中以下哪一条不为必须达到的
A. 关联的强度
B. 关联的时间顺序
C. 终止效应
D. 关联的剂量-反应关系

正确答案：C。终止效应

解析：本题考查希尔病因推断。流行病学病因研究中终止效应（C错，为本题正确答案）不为必须达到的，关联的强度（A对）、关联的时间顺序（B对）、关联的剂量-反应关系（D对）都可以达到。